女，35岁，G3P1，妊娠42+2周，既往月经规律。未临产，6年前自然顺产一男婴，人工流产一次，查体：T36.8℃，P70次/分，R14次/分，BP：140/85mmHg。产科检查：腹围98cm，枕先露，胎头浮，胎心140次/分，宫颈软，宫口未开。核对孕周还需要核对什么信息
A. 妊娠反应出现的时间
B. 胎儿身长
C. 宫底高度
D. 估计胎儿体重
E. 停经时间

正确答案：C。宫底高度

解析：妊娠反应、停经时间和估计胎儿体重估算孕周（ADE错）都不够准确。中晚期妊娠需要手测宫底高度判断妊娠周数（C对）。早期妊娠可以通过超声确认妊娠11-13 +6周测量胎CRL来估计孕龄，妊娠14周则采用双顶径、头围、腹围和股骨长度综合判断孕龄（B错）。